男，36岁。左上臂切割伤5小时。查体：T37.2℃，P70次/分，BP100/60mmHg。左侧小指感觉消失，环、小指末节屈曲功能障碍，最可能的原因是
A. 桡神经浅支损伤
B. 正中神经损伤
C. 尺神经损伤
D. 肌皮神经损伤
E. 桡神经深支损伤

正确答案：C。尺神经损伤

解析：患者中年男性，左上臂切割伤5小时。左侧小指感觉消失，环、小指末节屈曲功能障碍（尺神经损伤的典型体征），根据患者的病史、体征，最可能的诊断是尺神经损伤（C对）。桡神经浅支损伤（A错）表现为伸腕、伸拇、伸指、前臂旋后障碍及手背挠侧（虎口区）感觉异常。典型的畸形是垂腕。正中神经损伤（B错）肘上损伤则所支配的前臂肌亦麻痹，除上述表现外，另有拇指和示、中指屈曲功能障碍。挠神经深支损伤（E错），因挠侧腕长伸肌功能完好，伸腕功能基本正常（挠偏），而仅有伸拇、伸指障碍，无手部感觉障碍。